某学校将开展艾滋病相关的健康教育活动，在活动开始要进行需求评价。需求评价应包括哪项内容
A. 查阅文献，了解最新的调查研究
B. 对本校学生进行艾滋病知识，态度、行为的基线调查
C. 对该校的班主任、校医等进行访谈
D. 对学生进行小组座谈
E. 以上几项全部包括

正确答案：E。以上几项全部包括